某男，48岁。急躁易怒，胸胁胀痛，口苦咽干，咳逆阵作，咳时面赤，痰黏；舌红苔薄黄，脉弦细数，证属肺阴不足、肝火上逆犯肺。宜采用的治法
A. 佐金平木法
B. 培土制水法
C. 金水相生法
D. 益火补土法
E. 培土生金法

正确答案：A。佐金平木法

解析：本题考查的是五行在疾病治疗中的应用。急躁易怒，胸胁胀痛，口苦咽干，咳逆阵作，咳时面赤，痰黏；舌红苔薄黄，脉弦细数，证属肺阴不足、肝火上逆犯肺。宜采用的治法佐金平木法（A对）。五行在疾病治疗中的应用：1.根据相生规律确定的治则治法：根据相生规律确定的基本治则，包括补母或泻子两个方面，即“虚则补其母，实则泻其子”。补母，适用于母子关系失调的虚证；泻子，适用于母子关系失调的实证。根据相生规律确定的治法，主要有滋水涵木法、培土生金法、金水相生法、益火补土法等。（1）滋水涵木法：通过滋补肝肾之阴，以涵敛潜制肝阳的治法，又称滋肾养肝法、滋补肝肾法。适用于肾阴亏虚，不能涵养肝木，而致肝阴不足，阴不制阳，肝阳偏亢之“水不涵木”证。临床可见头目眩晕，两目干涩，颧红耳鸣，五心烦热，腰膝酸软，男子遗精，女子月经不调，舌红少苔，脉弦细而数等症。（2）金水相生法（C错）：滋补肺肾阴虚的治法，又称补肺滋肾法、滋养肺肾法。适用于肺阴虚不能布津以滋肾，或肾阴亏虚，不能上荣于肺，而致肺肾阴虚的病证。临床可见咳嗽气逆，干咳少痰或咯血，音哑，潮热盗汗，腰膝酸软，遗精，体瘦，口干，舌红少苔，脉细数等症。（3）培土生金法（E错）：通过补脾益气而补益肺气的治法，又称补养脾肺法。适用于脾胃气虚，生化减少，而致肺气失养的肺脾气虚证。临床可见久咳，痰多清稀，食欲减退，大便溏薄，四肢无力，舌淡脉弱等症。（4）益火补土法（D错）：温肾阳以补脾阳的治法，又称温肾健脾法。（火，在此是指命门之火，而非心火。益火，补益命门之火，即温肾阳之法。）适用于肾阳衰微而致脾阳不振的脾肾阳虚证。临床可见畏寒肢冷，腰膝冷痛，腹泻，完谷不化，或五更泄泻，舌淡胖边有齿痕，苔白滑，脉沉无力等症。2.根据相克关系确定的治则治法：根据相克关系确定的基本治则，包括抑强，或扶弱两个方面，即泻其乘侮之太过，补其乘侮之不及。抑强，适用于相克太过引起的相乘和相侮。扶弱，适用于相克不及引起的相乘和相侮。根据五行相克规律确定的治法，主要有抑木扶土法、培土制水法、佐金平木法、泻南补北法等。（1）抑木扶土法：疏肝健脾或平肝和胃的治法，又称疏肝健脾法、调和肝胃法，适用于木旺乘土或土虚木乘之证。具体应用时，对木旺乘土之证，以抑木为主，扶土为辅；对土虚木乘之证，以扶土为主，抑木为辅。（2）培土制水法（B错）：健脾利水以制约水湿停聚的治法，又称敦土利水法，适用于脾虚不运、水湿泛溢而致水肿胀满的证候。（3）佐金平木法：滋肺阴、清肝火的治法，又称滋肺清肝法，适用于肺阴不足、肝火上逆犯肺之证。若因肝火太盛，耗伤肺阴的肝火犯肺之证，又当清肝火为主，兼以滋肺降气。（4）泻南补北法：泻心火、补肾水的治法，又称泻火补水法、滋阴降火法，适用于肾阴不足，心火偏旺，水火未济，心肾不交之证。